阿托品的不良反应是
A. 乏力
B. 瞳孔缩小
C. 心动过缓
D. 泌汗减少，夏日易中暑
E. 呕吐

正确答案：D。泌汗减少，夏日易中暑

解析：本题考查阿托品的不良反应。阿托品属胆碱受体阻断药，能够抑制腺体分泌，排汗减少导致散热减少，夏日易中暑（D对）；阿托品可阻断瞳孔括约肌上的M受体，导致扩瞳（B错）；阿托品较大剂量时可阻断心脏窦房结M受体，使心率加快（C错）；阿托品不引起乏力（A错）、呕吐（E错）等不良反应。